患者3年来经常心悸，气短。检查：心尖搏动稍向左下移位，心浊音界稍向左下扩大，心尖部听诊可闻及3/6级以上粗糙的收缩期吹风样杂音，及舒张期隆隆样杂音。应首先考虑的是
A. 单纯二尖瓣狭窄
B. 单纯二尖瓣关闭不全
C. 二尖瓣狭窄及二尖瓣关闭不全
D. 主动脉瓣狭窄
E. 主动脉瓣关闭不全

正确答案：C。二尖瓣狭窄及二尖瓣关闭不全

解析：患者心尖搏动向左下移位提示左心室肥大，心尖部听诊可闻及3/6级以上粗糙的收缩期吹风样杂音，提示二尖瓣关闭不全，舒张期隆隆样杂音提示二尖瓣狭窄故患者应首先考虑的是二尖瓣狭窄及二尖瓣关闭不全（C对）。舒张期隆隆样杂音及开放拍击音（开瓣音）见于单纯二尖瓣狭窄（A错）。心尖区粗糙的吹风样收缩期杂音见于二尖瓣关闭不全（B错）。主动脉瓣区喷射性收缩期杂音见于主动脉瓣狭窄（D错）。主动脉瓣关闭不全心脏可听到舒张期杂音（E错）。